患者，女性，50岁，因上颌窦癌行上颌骨全切除术，口腔内创面需行游离植皮术，在右大腿取皮。应选择切取哪一类皮片
A. 表层皮片
B. 薄中厚皮片
C. 厚中厚皮片
D. 全厚皮片
E. 带真皮下血管网的全厚皮片

正确答案：B。薄中厚皮片

解析：本题考查游离皮片移植的适应证。此患者需口内进行皮片移植，中厚皮片包括表皮及一部分真皮层，根据厚度又可分为薄中厚皮片及厚中厚皮片，收缩较小，且较柔软，耐受摩擦，其中薄中厚皮片（B对）厚度与口腔黏膜相近，通常用于口内皮片移植。表层皮片（A错）多用于有感染的肉芽创面或骨面，此患者行上颌骨全切除术，无感染创面。厚中厚皮片（C错）和全厚皮片（D错）以及带真皮下血管网的全厚皮片（E错）多用于面颈部植皮。